卵巢黄体功能不全子宫内膜的表现是
A. 月经5～6日刮宫子宫内膜呈增生和分泌并存
B. 月经5～6日刮宫子宫内膜呈分泌型
C. 经前诊断性刮宫子宫内膜呈增生型
D. 经前诊断性刮宫子宫内膜呈蜕膜反应
E. 经前诊断性刮宫子宫内膜呈分泌不良

正确答案：E。经前诊断性刮宫子宫内膜呈分泌不良

解析：卵巢黄体功能不全子宫内膜的表现是，经前诊断性刮宫子宫内膜呈分泌不良（E对CD错）。月经5～6天刮宫子宫内膜呈增殖期与分泌期并存（P351）（A错）、月经5～6日刮宫子宫内膜呈分泌型（P351）（B错）为子宫内膜不规则脱落的表现。经前诊断性刮宫子宫内膜呈增生型（P345）（C错）是无排卵性功血患者子宫内膜的表现。经前诊断性刮宫子宫内膜呈蜕膜反应（D错）为早期妊娠的表现。